最容易被甲基汞污染的食物是
A. 藻类植物
B. 鱼贝类食品
C. 乳制品
D. 谷类
E. 蔬果类

正确答案：B。鱼贝类食品

解析：本题考查最容易被甲基汞污染的食物。含汞的废水排入江河湖海后，其中所含的金属汞或无机汞可以在水体（尤其是底层污泥）中某些微生物体内甲基钴氨酸转移酶的作用下，转变为甲基汞；如果在硫化氢存在的情况下可转变为二甲基汞，并可由于食物链的生物富集作用而在鱼体内达到很高的含量。因此，最容易被甲基汞污染的食物是鱼贝类食品（B对ACDE错）。